其研究为了确定放射性物质与肺癌的关系，调查了两个工厂1945～1975年曾使用放射性物质的情况，A厂使用过，B厂未使用过，现肺癌的死亡率前者高于后者，此研究属于
A. 定群研究
B. 历史定群研究
C. 病例对照研究
D. 现况研究
E. 个案研究

正确答案：B。历史定群研究

解析：本题考查回顾性队列研究。回顾性队列研究又称历史性定群研究，其主要特点是在研究开始时，暴露和疾病均已发生。研究者先追溯有关历史资料确定暴露组和对照组，然后通过各种途径查出这些对象的发病和死亡情况。可知本题研究属于历史性定群研究（B对ACDE错）。